患者，女性，35岁，某大学教师，3个月前因出国问题与领导争吵，而后逐渐表现出情绪低落、兴趣减退，对未来悲观失望，认为领导和同事都疏远她，常有怨天尤人的表现；能主动求医，接触良好。针对此例，在心理评估上宜采用
A. 调查法
B. 观察法
C. 会谈法
D. 作品分析法
E. 心理测验法

正确答案：C。会谈法